下列中成药组中联用降低西药不良反应的是
A. 逍遥散与抗痨药
B. 大山楂丸与抗癫痫药
C. 莱阳梨止咳糖浆与强心药
D. 复方川贝精片与降压药
E. 防风通圣丸与解热镇痛药

正确答案：A。逍遥散与抗痨药

解析：本题考查的是降低西药不良反应的中成药。下列中成药组中联用降低西药不良反应的是逍遥散与抗痨药（A对）。抗痨药即抗结核药。逍遥散有保肝作用，与西药抗结核药联用，能减轻西药抗结核药对肝脏的损害。大山楂丸与抗癫痫药（B错）联用有协同增效作用。大山楂丸、灵芝片、癫痫宁（含马蹄香、石菖蒲、甘松、牵牛子、千金子等）与苯巴比妥联用，治疗癫痫有协同增效作用。莱阳梨止咳糖浆与强心药（C错）、复方川贝精片与降压药（D错）不宜联用。含麻黄碱的中药及其中成药，如复方川贝精片、莱阳梨止咳糖浆、复方枇杷糖浆等，不可与强心药、降压药联用。因麻黄碱会兴奋心肌β受体、加强心肌收缩力，与洋地黄、地高辛等联用时，可使强心药的作用增强，毒性增加，易致心律失常及心衰等毒性反应，同时麻黄碱也有兴奋α受体和收缩周围血管的作用，使降压药作用减弱，疗效降低，甚至使血压失去控制，可加重高血压患者的病情。防风通圣丸与解热镇痛药（E错）同用会产生毒副作用。发汗解表药荆芥、麻黄、生姜等及其制剂（如防风通圣丸），与解热镇痛药阿司匹林、安乃近等合用，可致发汗太过，发生虚脱。